龛影的主要X线表现是
A. 圆形钡斑
B. 钡斑周围环绕透明带
C. 胃黏膜溃烂
D. 向腔外突出的钡斑阴影
E. 胃壁僵直

正确答案：D。向腔外突出的钡斑阴影

解析：是由充钡的胃肠轮廓某局部向外凸出的含钡影像。来自胃肠道壁的局限性缺损，见于胃肠道溃疡，也是作为描述溃疡的钡剂造影表现.。从正面观，龛影呈圆形或椭圆形，边缘整齐，向腔外突出的钡斑阴影是主要表现（D对）。因周围的炎性水肿而形成环形透亮区（B错），在溃疡口部可见一较宽的（0.5～1.0cm）透光带，宛如颈部带有一个项圈，称为溃疡项圈（A错），它是悬浮的水肿黏膜所造成。胃黏膜溃烂（C错）为胃镜所观察到的，X线不能看到。胃壁僵直（E错）为胃癌晚期的征象。